某医师在为患者施行右侧乳房肿瘤摘除术时，发现左侧乳房也有肿瘤，当即进行活险，确诊为乳腺病。医师判断将来可能癌变，未征求患者意见，同时切除了左侧乳房。医师的这种做法，违背了患者权利的哪点
A. 平等的医疗权
B. 保密权
C. 隐私权
D. 知情同意权
E. 获得信息权

正确答案：D。知情同意权